蒽醌类化合物的质谱特征是依次脱去
A. CO
B. CHO
C. C00H
D. OH
E. CH2=CH2

正确答案：A。CO